耻骨骨折不易出现
A. 血尿
B. 会阴部瘀斑
C. 坐骨神经损伤
D. 骨盆挤压试验阳性
E. 骨盆分离试验阳性

正确答案：C。坐骨神经损伤

解析：坐骨神经源自腰4、5和骶1-3神经。经坐骨切迹穿梨状肌下缘入臀部，在臀大肌深面、大转子与坐骨结节中点下行，距离耻骨较远，故耻骨骨折较少出现坐骨神经损伤（C错，为本题正确答案）。坐骨神经损伤常见于髋关节后脱位、臀部刀伤、臀肌挛缩手术伤以及臀部肌注药物等。耻骨支骨折移位容易引起尿道损伤，出现血尿（A对）。骨折端周围软组织血管损伤，血液渗入皮下，导致会阴部瘀斑（B对）。耻骨骨折是一种较为常见的骨盆骨折，多有强大暴力外伤史。骨盆分离试验与挤压试验阳性（DE对）为耻骨骨折、坐骨骨折等骨盆骨折的典型体征。